依据有关司法解释，生产、销售假药应认定为刑法第141条规定的“足以严重危害人体健康”的情况是
A. 生产、销售的假药被使用后，使人造成轻伤、重伤的
B. 生产、销售的假药经法定药品检验机构鉴定，含有超标准的有毒有害物质的
C. 生产、销售的假药使用后，致人严重残疾的
D. 生产、销售的假药被使用后，使三人以上重伤，十人以上轻伤的
E. 生产、销售的假药被使用后，致人死亡的

正确答案：B。生产、销售的假药经法定药品检验机构鉴定，含有超标准的有毒有害物质的